不良反应最小，可进入脑脊液的咪唑类抗真菌药是
A. 克霉唑
B. 咪康唑
C. 酮康唑
D. 氟康唑
E. 氟胞嘧啶

正确答案：D。氟康唑